关于肠系膜下淋巴结的描述，何者错误
A. 收纳左右结肠淋巴结的输出管
B. 位于肠系膜下动脉根部周围
C. 收纳乙状结肠淋巴结的输出管
D. 收纳直肠上淋巴结的输出管
E. 其输出管参与组成肠干

正确答案：A。收纳左右结肠淋巴结的输出管

解析：肠系膜下淋巴结收纳左结肠淋巴结（A错，为本题正确答案）、乙状结肠淋巴结（C对）和直肠上淋巴结（D对）的输出管。位于肠系膜下动脉根部周围（B对）。其输出管和腹腔淋巴结、肠系膜上淋巴结的输出管共同参与组成肠干（E对）。